患者腹痛，里急后重，下痢赤白相杂，肛门灼热，小便短赤，舌苔微黄，脉滑数。其治法是
A. 清热解毒，调气行血
B. 清热化湿，理气止痛
C. 清热凉血，和胃利湿
D. 清肠和胃，利湿解毒
E. 清胃利湿，和胃通降

正确答案：A。清热解毒，调气行血

解析：患者腹痛，里急后重，下痢赤白相杂可诊断为痢疾。湿热壅滞，气血凝滞，肠络受损，传导失司，故腹痛里急后重；湿热之毒熏灼，伤及肠道脂膜之气血，腐败化为脓血，则下痢赤白相杂；湿热下注则肛门灼热，小便短少。故为湿热痢，治则清热解毒，调气和血（A对）。